明确诊断肺血栓栓塞症首选的检查是
A. CT肺动脉造影
B. 血D-二聚体
C. 肺动脉造影
D. 肺通气灌注扫描
E. 超声心动图

正确答案：A。CT肺动脉造影

解析：CT是肺血栓栓塞的一线确诊手段，采用特殊操作技术进行CT肺动脉造影（A对），能够准确发现段以上肺动脉栓塞。血D-二聚体是纤溶过程中的特异性标志物，对血栓形成具有很高的敏感性，但因特异性差（B错），仅用于肺血栓栓塞的排除诊断。肺动脉造影敏感性和特异性均较高，是肺血栓栓塞诊断的金标准，但其为有创性检查，一般不作为首选（C错）。肺通气灌注扫描对于远端肺栓塞诊断价值较高，但一般不作为首选检查（D错）。超声心动图可发现右室功能障碍的一些表现，对肺栓塞的诊断有一定间接提示意义（E错）。